化脓性颌骨骨髓炎最常见的感染途径是
A. 腺源性感染
B. 牙源性感染
C. 血源性感染
D. 损伤性感染
E. 医源性感染

正确答案：B。牙源性感染

解析：牙源性感染临床上最为多见，约占化脓性颌骨骨髓炎的90%。一般常见由急性根尖周炎、牙周炎、智牙冠周炎等引起。掌握“颌骨骨髓炎”知识点。